女，22岁。头晕、呕吐伴流涎半小时。1小时前曾少量饮酒并进食较多凉拌蔬菜。查体：P55次/分，BP100/70mmHg，神志清晰，皮肤潮湿，双瞳孔针尖样大小，双下肺可闻及湿啰音。最可能的诊断是
A. 亚硝酸盐中毒
B. 杀鼠药中毒
C. 吗啡中毒
D. 有机磷农药中毒
E. 乙醇中毒

正确答案：D。有机磷农药中毒

解析：青年女性患者，进食凉拌蔬菜后（可能存在有机磷农药残留）出现头晕、呕吐伴流涎半小时。查体：P55次/分（心率降低），皮肤潮湿（汗腺分泌增多），双瞳孔针尖样大小（瞳孔极度缩小），双下肺可闻及湿啰音（气道分泌物增多），以上临床表现提示患者存在典型的毒蕈碱样症状。综合该患者的病史及体查，最可能的诊断是有机磷农药中毒（D对）。亚硝酸盐中毒（A错）多有误服工业用亚硝酸盐史，中毒表现为组织缺氧而致的发绀，有条件时可做血液中高铁血红蛋白的定量检验和剩余食物中亚硝酸盐的定量检验。抗凝血杀鼠剂是应用最广泛的杀属剂，亦是最常导致杀鼠药中毒（B错）的杀鼠剂，早期表现为恶心、呕吐、腹痛、头晕、乏力等症状，1～3天后出现不同程度的出血症状。吗啡中毒（C错）有吗啡使用史，轻度急性中毒表现为头痛、头晕。恶心、呕吐、兴奋或抑制，并可有便秘、尿潴留及血糖增高、血压下降和脉搏减慢；重度中毒时有昏迷、针尖样瞳孔和呼吸抑制三大特征。乙醇中毒（E错）常有酗酒史，临床上分为三期（P900）：①兴奋期：患者开始极度兴奋，情绪奔放、情绪极端不稳定，时悲时喜，面色则表现为苍白或潮红，眼结膜充血；②共济失调期：表现为步履蹒跚、动作笨拙、语无伦次、言语不清；③昏迷期，表现昏睡、瞳孔散大、体温降低；重者可出现呼吸、循环麻痹而危及生命。